3095-2012）的基本项目中，对几种污染物制定了限值
A. 10种
B. 2种
C. 4种
D. 6种
E. 8种

正确答案：D。6种

解析：本题考查《环境空气质量标准》。我国《环境空气质量标准》（GB 3095-2012）的基本项目中，对6种（D对ABCE错）污染物制定了限值，分别是：二氧化硫、二氧化氮、一氧化碳、臭氧、颗粒物（粒径小于等于10μm）、颗粒物（粒径小于等于2.5μm）。